梅毒的病原体是
A. 苍白密螺旋体
B. 人乳头瘤病毒
C. 沙眼衣原体
D. 解脲支原体
E. 人免疫缺陷病毒

正确答案：A。苍白密螺旋体

解析：梅毒的病原体是苍白密螺旋体（A对）。人乳头瘤病毒（HPV）（B错）主要引起人类皮肤黏膜的增生性病变，低危性HPV（6型、11型等）引起生殖器尖锐湿疣，高危型HPV（16型、18型等）与子宫颈癌等恶性肿瘤的发生密切相关（P316）。沙眼衣原体（C错）根据感染机体部位不同，可引起不同类型的疾病，如傻眼、新生儿眼炎、包涵体结膜炎、尿道炎等（P193表20-3）。解脲支原体（解脲脲原体、溶脲脲原体）（D错）是人类泌尿生殖道常见的寄生菌之一，为人类非淋菌性尿道炎的重要病原体（P181）。人免疫缺陷病毒（HIV）（E错）是获得性免疫缺陷综合征（AIDS）即艾滋病的病原体（P305）。